肿而不硬，皮色苍白或紫暗，皮肤冷清，是指
A. 风肿
B. 寒肿
C. 热肿
D. 湿肿
E. 痰肿

正确答案：B。寒肿

解析：肿而不硬，皮色苍白或紫暗，皮肤冷清，符合寒肿的特点（B对），常见于冻疮、脱疽等。风肿的特点是发病急骤，漫肿宣浮，或游走无定，不红微热，或轻微疼痛（A错）。热肿的特点是肿而色红，皮薄光泽，焮热疼痛，肿势急剧（C错）。湿肿的特点是皮肉重垂胀急，深按凹陷，如烂棉不起，浅则光亮如水疱，破流黄水，浸淫皮肤（D错）。痰肿的特点是肿势软如棉，或硬如馒，大小不一，形态各异，无处不生，不红不热，皮色不变（E错）。